男，53岁，2型糖尿病，控制饮食无效，体重超重，过度肥胖，选下列哪种降糖药为最佳
A. 格列齐特
B. 格列苯脲
C. 甲苯磺丁脲
D. 格列吡嗪
E. 甲福明

正确答案：E。甲福明

解析：二甲双胍作用机制是促进脂肪组织摄取葡萄糖，降低葡萄糖的肠吸收及糖异生，抑制胰高血糖素释放等，主要用于轻症糖尿病患者，尤其适用于肥胖及单用饮食控制无效者。掌握“胰岛素、磺酰脲类及双胍类药”知识点。